下列有关糖尿病的叙述，正确的是
A. 所有的糖尿病人都有“三多一少”的症状
B. 部分2型糖尿病患者餐后3～5小时血糖降低
C. 糖尿病患者脂肪分解减少，蛋白质代谢正常
D. 2型糖尿病患者起病急，病情重，症状明显
E. 儿童糖尿病患者多食多饮，其生长发育加快

正确答案：B。部分2型糖尿病患者餐后3～5小时血糖降低

解析：本题考查糖尿病。2型糖尿病为非胰岛素依赖型糖尿病，部分2型糖尿病患者餐后3～5小时血糖降低（B对）。许多糖尿病患者并无明显症状，部分可有多饮、多尿、多食、消瘦和体重减轻（A错）等症状。糖尿病患者体内碳水化合物、脂肪和蛋白质的代谢失衡（C错）。2型糖尿病患者一般起病缓慢，无症状的时间长（D错）。儿童糖尿病患者一般临床表现为多食多饮多尿，身体消瘦（E错）。